妊娠早期妇女使用可引起胎儿畸形的药品是
A. 氨基糖苷类
B. 氮芥类
C. 甲巯咪唑
D. 头孢菌素类
E. 胰岛素

正确答案：B。氮芥类

解析：本题考查妊娠期妇女用药。氮芥类（B对）为烷化剂，妊娠早期妇女使用可引起泌尿生殖系统异常，指（趾）畸形。氨基糖苷类（A错）：妊娠期妇女使用可致胎儿永久性耳聋。甲巯咪唑（C错）：妊娠期妇女使用可致胎儿甲状腺功能低下。头孢菌素（D错）应用于妊娠和哺乳期妇女尚未见发生问题，但仍需慎用。胰岛素（E错）在妊娠期应用时，尽量使用生物合成的人胰岛素。